解毒、燥湿的药组为
A. 黄芩、穿心莲
B. 黄连、金银花
C. 黄柏、夏枯草
D. 连翘、蒲公英
E. 射干、马齿苋

正确答案：A。黄芩、穿心莲

解析：黄芩为清热燥湿药，苦寒，有清热燥湿，泻火解毒，止血，安胎的功效；穿心莲为清热解毒药，苦寒，有清热解毒，凉血，消肿，燥湿的功效。二者均可解毒燥湿（A对）。黄连可清热燥湿、泻火解毒；金银花可清热解毒、疏散风热，无燥湿的功效（B错）。黄柏可清热燥湿、泻火解毒、除骨蒸；夏枯草可清肝泻火、明目、散结消肿，无解毒燥湿的功效（C错）。连翘可清热解毒、消肿散结、疏散风热；蒲公英可清热解毒、消肿散结、利湿通淋。二者均无燥湿的功效（D错）。射干可清热解毒、消痰、利咽；马齿苋可清热解毒、凉血止血、止痢。二者均无燥湿的功效（E错）。